“四E干预”不包括
A. 工程干预
B. 经济干预
C. 强制干预
D. 社会干预
E. 教育干预

正确答案：D。社会干预

解析：本题考查四E干预的措施。四E干预主要包括：①工程干预（A对）；②经济干预（B对）；③强制干预（C对）；④教育干预（E对）。社会干预（D错，为本题正确答案）不属于四E干预。